有关滴眼剂错误的叙述是
A. 滴眼剂是直接用于眼部的外用液体制剂
B. 正常眼可耐受的pH值为5.0～9.0
C. 混悬型滴眼剂要求粒子大小不得超过50㎛
D. 滴入眼中的药物首先进入角膜内，通过角膜至前房再进入虹膜
E. 增加滴眼剂的黏度，使药物扩散速度减小，不利于药物的吸收

正确答案：E。增加滴眼剂的黏度，使药物扩散速度减小，不利于药物的吸收

解析：本题考查滴眼剂。适当增加滴眼剂的黏度可延长药物在作用部位的时间，有助于药物发挥作用（E错，为本题正确答案）；滴眼剂为直接用于眼部的外用液体制剂（A对）；眼部可耐受的pH值为5.0～9.0（B对）；根据眼用制剂的质量要求，混悬型眼用制剂大于50㎛的粒子不超过2个（C对）；滴入眼中的药物首先进入角膜，通过角膜至前房再进入虹膜（D对）。